男，72岁。突发头痛10小时，昏迷8小时。头颅CT右颞叶出血。1小时来呕暗红色血2次，共约350ml。无慢性肝病史。最可能的呕血原因是
A. 急性胃粘膜病变
B. 胃癌
C. 十二指肠溃疡
D. 贲门粘膜撕裂
E. 食管胃底静脉曲张破裂

正确答案：A。急性胃粘膜病变

解析：患者为老年男性，右侧颞叶出血并已昏迷8小时提示严重脑外伤，呕血350ml，无慢性肝病史，呕血病因考虑为脑出血后引起的应激性溃疡，表现为急性胃粘膜病变（A对）。颅内出血后，交感神经兴奋，肾上腺髓质分泌儿茶酚胺增多，使胃黏膜下血管发生挛缩性收缩，组织灌流量显著下降，导致胃粘膜缺血、缺氧，以至于发生表浅的、边缘平坦的溃疡或大小不等的糜烂灶，导致上消化道出血。胃癌（B错）、十二指肠溃疡（C错）可引起上消化道出血，但该患者缺乏相应的病史。贲门粘膜撕裂（D错）表现为剧烈呕吐后呕血，系因剧烈呕吐导致贲门粘膜撕裂，导致上消化道出血。食管胃底静脉曲张破裂（E错）多由肝炎、肝硬化门脉高压引起，该患者缺少肝炎病史。